女性，35岁。皮下结节2年，1个月来癫痫发作频繁。查体：躯干、四肢、头皮下可触及多个0.5cm✕1cm大小的圆形结节，无触痛，与周围无粘连。进一步必做的辅助检查是
A. 头颅CT或MRI
B. 腰穿
C. 胸部X线
D. 自身免疫抗体检测
E. 脑血管造影

正确答案：A。头颅CT或MRI